根据《麻醉药品、第一类精神药品购用印鉴卡管理规定》，不需要办理《印鉴卡》变更手续的项目是
A. 医疗机构法定代表人的变更
B. 医疗管理部门负责人的变更
C. 药剂科主任的变更
D. 具有麻醉药品处方审核资格的药师的变更
E. 麻醉药品采购人员的变更

正确答案：D。具有麻醉药品处方审核资格的药师的变更

解析：本题考查麻醉药品和第一类精神药品购用印鉴卡管理。根据《麻醉药品、第一类精神药品购用印鉴卡管理规定》，不需要办理《印鉴卡》变更手续的项目是具有麻醉药品处方审核资格的药师的变更（D错，为本题正确答案）。当《印鉴卡》中医疗机构名称、地址、医疗机构法人代表（负责人）（A对）、医疗管理部门负责人（B对）、药学部门负责人（C对）、采购人员（E对）等项目发生变更时，医疗机构应当在变更发生之日起3日内到市级卫生健康主管部门办理变更手续。